沃辛瘤病史特点包括
A. 多见于男性，男女比例约6：1
B. 好发于40～70岁中老年
C. 发病可能与吸烟有关
D. 有消长史
E. 以上均是特点

正确答案：E。以上均是特点

解析：本题考查沃辛瘤的临床特点。沃辛瘤又称腺淋巴瘤，其组织发生与淋巴结有关，其多见于男性，男女比例约6：1（A对）；好发年龄在40～70岁的中老年（B对）；常有吸烟史（C对）；由于沃辛瘤是肿瘤性上皮和大量淋巴样间质所组成，淋巴样间质很容易发生炎症，故其可有消长史（D对）；绝大多数肿瘤位于腮腺后下极；扪诊肿瘤呈圆形或卵圆形表面光滑，质地较软；肿瘤常呈多发性；术中可见肿瘤呈紫褐色，剖面可见囊腔形成，内含干酪样或黏稠液体；核素显像呈热结节是其特征性表现。（ABCD均对，故E为本题的正确答案）。